某女，56岁。近日出现气短心悸、失眠多梦、头昏头晕、肢倦乏力、食欲不振、崩漏便血等症。遂就医，医师诊断为心脾两虚，处以归脾丸。处方组成：党参80g、炒白术160g、炙黄芪80g、炙甘草40g、茯苓160g、制远志160g、炒酸枣仁80g、龙眼肉160g、当归160g、木香40g、大枣（去核）40g。以上十一味，党参、当归、炙甘草、木香粉碎成细粉，其余炒白术等七味，加水煎煮两次，合并煎液，滤过，浓缩得稠膏，与上述粉末混匀，制成浓缩水丸。取本品制片，置显微镜下观察，可见纤维成束或散离，壁厚，表面有纵裂纹，两端断裂成帚状或较平截。处方中具有该特征的饮片是
A. 党参
B. 炙黄芪
C. 当归
D. 炙甘草
E. 炒白术

正确答案：B。炙黄芪

解析：本题考查黄芪的显微鉴别。处方中，显微鉴别可见维成束或散离，壁厚，表面有纵裂纹初生壁常与次生壁分离，两端断裂成帚状或较平截的是炙黄芪（B对）。黄芪【显微鉴别】粉末黄芪、黄芪片、炙黄芪：纤维成束或散离，直径8～30㎛，壁厚，表面有纵裂纹，初生壁常与次生壁分离，两端断裂成帚状或较平截。具缘纹孔导管无色或橙黄色，具缘纹孔排列紧密。木栓细胞表面观为类多角形或类方形，垂周壁薄，有的呈细波状弯曲。党参（A错）【显微鉴别】粉末党参、党参片、米炒党参：联结乳管直径12～24㎛，含淡黄色细小颗粒状物；石细胞斜方形、长方形或多角形，一端稍尖，壁较厚，纹孔稀疏。有菊糖，水合氯醛装片不加热，菊糖结晶呈扇形。当归（C错）【显微鉴别】粉末当归、酒当归：韧皮薄壁细胞纺锤形，壁略厚，表面有极微细的斜向交错纹理。有时可见菲薄的横隔。梯纹导管和网纹导管多见。有时可见油室碎片。甘草【显微鉴别】粉末甘草、甘草片、炙甘草（D错）：纤维成束，直径8～14㎛，壁厚，微木化，周围薄壁细胞含草酸钙方晶，形成晶纤维。草酸钙方晶多见。木栓细胞红棕色，多角形，微木化。具缘纹孔导管较大。白术【显微鉴别】粉末白术、麸炒白术（E错）：草酸钙针晶细小，长10～32㎛，不规则地充塞于薄壁细胞中。纤维长梭形，大多成束，壁甚厚，木化，孔沟明显。石细胞淡黄色，类圆形、多角形、长方形或少数纺锤形。薄壁细胞含菊糖，表面显放射状纹理。